与受体有较强亲和力，但缺乏内在活性的药物是
A. 激动药
B. 部分激动药
C. 负性激动药
D. 拮抗药
E. 受体调节剂

正确答案：D。拮抗药

解析：本题考查作用于受体药物的分类。与受体有较强亲和力，但缺乏内在活性的药物是拮抗药（D对）。拮抗药是指能与受体结合，具有较强亲和力而无内在活性（α=0）的药物。激动药（A错）是指既有亲和力又有内在活性的药物。部分激动药（B错）具有较强亲和力，但内在活性低（α＜1），与受体结合后只能产生较弱的效应。负性激动药（C错）是指引起与原来的激动药相反的生理效应。